按照临床诊疗道德的最优化原则，医务人员不需要考虑的是
A. 患者的地位
B. 医疗安全
C. 医疗效果
D. 诊疗费用
E. 患者的痛苦

正确答案：A。患者的地位

解析：临床诊疗道德的最优化原则是指认真、仔细地选择使病人受益与代价比例适当的优化治疗措施的临床伦理准则，其内容主要包括疗效最好（C对）、安全无害（B对）、痛苦最小（E对）和耗费最少（D对），不需要考虑患者的地位（A错，为本题正确答案）。